以下关于平滑面龋的描述中，正确的说法是
A. 多见于颊舌面近牙冠部
B. 病变呈口小底大的形态
C. 龋斑能自行恢复
D. 龋缘处的龋斑呈圆形
E. 多发生在邻面接触点的下方

正确答案：E。多发生在邻面接触点的下方

解析：本题考查牙釉质龋。以下关于平滑面龋的描述中，正确的说法是多发生在邻面接触点的下方（E对）。平滑面龋多见于牙邻接面接触点下方、颊舌面近龈缘牙颈部。早期表现为牙表面白垩色不透明区，与周围正常的透明釉质不同，这种不透光是由于釉质的脱钙使其光折射率改变。